平滑面龋透明层孔隙所占容积
A. 0.01
B. 0.05
C. 2～4%
D. 5%～25%
E. 10%～30%

正确答案：A。0.01

解析：透明层位于病损的最前沿，和正常釉质相连，是龋损最早发生的组织学改变。此层釉质晶体开始出现脱矿，晶体间孔隙较正常釉质增大，孔隙容积约为1%。掌握“牙釉质龋”知识点。